某厂20～24岁组工人500名，某年内2人死于肺癌，已知该年全人口20～24岁组肺癌的死亡率为1‰，则SMR为
A. 2.5
B. 2
C. 4
D. 5
E. 10

正确答案：C。4